患者，男，50岁。颊侧黏膜处反复出现电击、针刺样疼痛，每次持续数十秒。其诊断首先考虑是
A. 牙痛
B. 偏头痛
C. 三叉神经痛
D. 颞下颌关节疾患
E. 舌咽神经痛

正确答案：C。三叉神经痛

解析：根据患者年龄，疼痛部位，疼痛性质，疼痛时间，应首先考虑三叉神经痛。掌握“三叉神经痛”知识点。